下列哪一条不是队列研究的特点
A. 主要的偏倚有选择偏倚、失访偏倚、信息偏倚和混杂偏倚
B. 暴露人年的计算繁琐
C. 结果可靠，多用于稀有之病
D. 能直接估计因素与发病联系和相关程度，可计算发病率
E. 因素的作用可分为等级，以便计算剂量-反应关系

正确答案：C。结果可靠，多用于稀有之病